乳剂中微生物作用可使乳剂出现哪种不稳定现象
A. 分层
B. 转相
C. 酸败
D. 絮凝
E. 破裂

正确答案：C。酸败

解析：本题考查乳剂。酸败（C对）是指乳剂受外界因素及微生物的影响，使其中的油、乳化剂等发生变质的现象。所以乳剂中通常需加入抗氧剂和防腐剂，防止氧化或酸败。分层（A错）的主要原因是分散相和分散介质之间的密度差。转相（B错）的主要原因是乳化剂的性质改变。絮凝（D错）的主要原因是Zeta电位降低。破裂（E错）的主要原因是乳化剂失去乳化作用。